职业病的主要发病危险因素是
A. 生物因素
B. 化学因素
C. 物理因素
D. 劳动过程中的有害因素
E. 生产环境中的有害因素

正确答案：B。化学因素

解析：本题考查职业病的主要发病危险因素。职业病的发病危险因素包括物理因素、化学因素、生物因素、劳动过程中的有害因素、生产环境中的有害因素等。其中化学因素（B对ACD错）是职业病的主要发病危险因素。